对奥美拉唑描述正确的有
A. 是前体药物
B. 具有手性，S和R两种光学异构体疗效一致
C. 口服后在十二指肠吸收
D. 为可逆性质子泵抑制剂
E. 在酸性的胃壁细胞中发挥作用

正确答案：A、B、C、E。是前体药物；具有手性，S和R两种光学异构体疗效一致；口服后在十二指肠吸收；在酸性的胃壁细胞中发挥作用

解析：本题考查奥美拉唑。奥美拉唑是一种前体药物（A对），为质子泵抑制剂，是一种脂溶性弱碱性药物。易浓集于酸性环境中，特异性地作用于胃黏膜壁细胞顶端膜构成的分泌性微管和胞质内的管状泡上，即强酸性的壁细胞泌酸小管口（E对），通过二硫键与质子泵的巯基发生不可逆行的结合，从而抑制H⁺，K⁺-ATP酶的活性（D错）。奥美拉唑具有手性，S和R两种光学异构体疗效一致（B对）。口服后在十二指肠吸收（C对），对十二指肠溃疡的治愈率较高，且复发率较低。